迸行系统综述的目的是
A. 提出一个临床实践问题
B. 严格评价证据
C. 应用最佳证据
D. 为循证医学提供最好的证据
E. 后效评价

正确答案：D。为循证医学提供最好的证据